农药残留检测是
A. 高效色谱检测
B. 气相色谱检测
C. 薄层色谱检测
D. 分光光度检测
E. 原子检测

正确答案：B。气相色谱检测

解析：本题考查的是气相色谱检测法。农药残留检测是气相色谱检测（B对）。气相色谱法最适用于含挥发油及其他挥发性成分的药材及中成药的分析，用于药品的鉴别、杂质检查、水分测定、农药残留量测定和含量测定。黄曲霉毒素的检查：黄曲霉毒素为黄曲霉等的代谢产物，是强烈的致癌物质。各国对食品和药品中黄曲霉毒素的限量都作了严格的规定，但目前还没有公认的植物药中黄曲霉毒素的限量标准。《中国药典》采用高效液相色谱法（A错），结合柱后衍生法和高效液相-串联质谱法测定药材、饮片及制剂中的黄曲霉毒素。薄层色谱法（C错）因其快速、简便和灵敏，是目前中药鉴定中用于定性鉴别使用最多的色谱法之一。可见分光光度法（D错）是比较溶液颜色深度以确定物质含量的方法。原子吸收分光光度法（E错）的特点为专属性强，检测灵敏度和精密度均高，测定速度快，是目前用于测定中药中重金属及有害元素、微量元素最常用的方法。